一侧颈淋巴清扫手术的体位是
A. 平卧头正位
B. 平卧头侧位
C. 平卧仰头位
D. 平卧低头位
E. 平卧垫肩头侧位

正确答案：E。平卧垫肩头侧位

解析：口腔颌面部手术野的显露好坏与手术切口设计、患者体位以及照明有直接关系。手术时应选择利于术野显露的体位，颌下、颈部手术应常规垫高肩部。掌握“口外手术组织切开、止血及组织分离”知识点。